关于胃食管反流病患者应用含铝抗酸药用药教育的说法，正确的有
A. 长期服用可能会引起低磷血症
B. 易引起腹泻
C. 可快速缓解症状，但对反流性食管炎的愈合几乎无作用
D. 可增加心血管事件发生风险
E. 与其它药物合用，通常要间隔2小时

正确答案：A、C、E。长期服用可能会引起低磷血症；可快速缓解症状，但对反流性食管炎的愈合几乎无作用；与其它药物合用，通常要间隔2小时

解析：本题考查含铝抗酸药用药教育。抗酸药可中和胃酸，常用药物是含有铝、镁等的碱性盐类及其复合制剂，可用于快速缓解症状，对溃疡愈合几乎无作用（C对）。抗酸药中铝制剂可引起便秘（B错），而镁制剂有缓泻作用，二者合用可抵消各自的副作用。铝制剂大量服用可导致肠梗阻，长期服用能引起低磷血症（A对）。镁制剂可引起高镁血症，三硅酸镁长期大量服用可引发肾硅酸盐结石。铝、镁抗酸药无心血管副作用（D错），但慎用于肾功能不全的患者。抗酸药与其它药物合用，通常要间隔2小时（E对），可避免大部分的药物相互作用。